50岁女性，孕5产5，绝经3年，阴道不规则流血1月。妇科检查：外阴阴道正常，宫颈肥大糜烂触之易出血，子宫后屈稍小，双侧附件未见异常。进一步确诊时需做
A. B型超声检查
B. 宫颈涂片细胞学检查
C. 宫颈活组织检查
D. 子宫颈碘试验
E. 阴道镜检查

正确答案：C。宫颈活组织检查

解析：患者为中老年妇女，绝经后出现阴道不规则流血（宫颈癌老年患者常为绝经后不规则阴道流血）。妇检：外阴阴道正常，宫颈肥大糜烂触之易出血（接触性出血），子宫后屈稍小，双侧附件未见异常，首先考虑为宫颈癌。宫颈癌的诊断应采用子宫颈细胞学检查（B错）和（或）高危型HPV DNA检测、阴道镜检查（E错）、子宫颈活组织检查的“三阶梯”程序，确诊依据为宫颈活组织检查（C对）。确诊后根据具体情况选择胸部X线、B型超声检查（A错）及CT、MRI等影像学检查。宫颈癌的宫颈上皮不含糖原，子宫颈碘试验（P444）（D错）为阴性，但柱状上皮、未成熟化生上皮及不典型增生上皮均不含糖原，碘实验同为阴性，急性宫颈炎时宫颈碘试验也可以阳性。